引起生物地球化学性疾病的主要原因是
A. 工业废弃物的排放
B. 生物性病原体的传播
C. 环境中某些元素含量过多
D. 环境中某些元素含量过少
E. 环境中某些元素含量过多或过少

正确答案：E。环境中某些元素含量过多或过少

解析：本题考查引起生物地球化学性疾病的主要原因。生物地球化学性疾病是由于地壳表面化学元素分布的不均匀性，使某些地区的水和（或）土壤中某些元素过多或过少（E对ABCD错），当地居民通过饮水、食物等途径摄入这些元素过多或过少，而引起某些特异性疾病。